通过直接抑制凝血酶而发挥作用的抗凝血药物是
A. 依诺肝素
B. 氯吡格雷
C. 华法林
D. 利伐沙班
E. 达比加群酯

正确答案：E。达比加群酯

解析：本题考查达比加群酯。通过直接抑制凝血酶而发挥作用的抗凝血药物是达比加群酯（E对）。达比加群酯是直接凝血酶抑制剂(DTIs），通过与凝血酶上的纤维蛋白原结合位点结合，阻止纤维蛋白原转化为纤维蛋白。依诺肝素（A错）临床使用用于预防深静脉血栓形成。氯吡格雷（B错）是二磷酸腺苷P2Y12受体阻断剂，能够抑制血小板聚集。华法林（C错）是属于维生素K拮抗剂的抗凝血药物。利伐沙班（D错）属于凝血因子Xa直接抑制剂的抗凝药，可直接抑制Xa因子，阻断凝血酶原转化为凝血酶，但不影响已形成的凝血酶活性。